成人阑尾切除术后一天出现烦躁、剧烈腹痛，心率112次/分，血压90/60mmHg，腹胀，全腹压痛，肠鸣音弱，为除外腹腔内出血，首要的检查是
A. B超
B. CT
C. MRI
D. 腹腔穿刺
E. 立位腹平片

正确答案：D。腹腔穿刺

解析：患者阑尾切除术后，若阑尾系膜的结扎线松脱，可能引起系膜血管出血。腹腔穿刺（D对）可快速、直观的判断有无腹腔内出血，应作为除外腹腔内出血时的首要检查。B超（A错）、CT（B错）、MRI（C错）、立位腹平片（E错）均能发现腹腔内积液，但对其性质缺少直观的判别，因此不作为首选。